性微温，能降气祛痰的药是
A. 芥子
B. 桔梗
C. 前胡
D. 白前
E. 竹茹

正确答案：D。白前

解析：本题考查的是白前的性味归经与功效。性微温，能降气祛痰的药是白前（D对）。白前：【性味归经】苦、辛，微温。归肺经。【功效】降气祛痰止咳。芥子（A错）：【性味归经】辛，温。归肺经。【功效】温肺祛痰，利气散结，通络止痛。桔梗（B错）：【性味归经】辛、苦，平。归肺经。【功效】宣肺，利咽，祛痰，排脓。前胡（C错）：【性味归经】苦、辛，微寒。归肺经。【功效】降气祛痰，宣散风热。竹茹（E错）【性味归经】甘，微寒。归肺、胃、胆经。【功效】清热化痰，除烦止呕，安胎。